垂体叙述错误的是
A. 位于背侧丘脑后上方
B. 呈淡红色的椭圆形小体
C. 分为腺垂体和神经垂体
D. 神经垂体分泌催产素
E. 腺垂体分泌多种激素

正确答案：D。神经垂体分泌催产素

解析：垂体后叶的主要功能是储存和释放抗利尿激素和催产素，并不是分泌（D错，为本题正确答案）。